引起可摘局部义齿固位不良的原因包括，除了
A. 基牙牙冠小
B. 基托与组织不密合，边缘封闭不好
C. 卡环与基牙不贴合
D. 人工牙排列位置不当
E. 倒凹区基托缓冲不够

正确答案：E。倒凹区基托缓冲不够

解析：本题考查可摘局部义齿固位不良的原因。倒凹区基托缓冲不够（E错，为本题的正确答案）可能是模型制作时没有填倒凹或者倒凹填充不足，导致基托就位困难，不是固位不良的原因。基牙牙冠小（A对），固位形差，三臂卡无法获得足够固位力，故可摘局部义齿固位不良。基托与组织不密合，边缘封闭不好（B对），没有充分利用基托的吸附力和大气压力的作用而影响基托的固位、稳定。卡环与基牙不贴合（C对），间接固位体放置的部位不当，牙合支托，卡环在牙面形成支点，卡环无固位力，还可能是卡环臂未进入基牙的倒凹区，而是抵住了邻牙，易发生弹跳致固位力差。人工牙排列位置不当（D对），若前牙排列的覆牙合过大，前伸时上颌义齿发生翘动；若后牙排列在牙槽嵴颊侧，咬合时以牙槽嵴为支点发生翘动；若排在舌侧，则影响舌的运动，均会导致固位不良。